乳牙常见的萌出顺序
A. A→B→C→D→E
B. A→B→D→C→E
C. A→B→C→E→D
D. A→B→D→E→C
E. A→C→B→D→E

正确答案：B。A→B→D→C→E

解析：本题考查乳牙的萌出顺序。胚胎2个月，乳牙胚即已发生，5～6个月钙化。新生儿颌骨内已有20个乳牙胚。乳牙于出生后半年左右开始萌出，约两岁半全部出齐。乳牙的萌出通常遵循一定的顺序，其萌出顺序约为：乳中切牙、乳侧切牙、第一乳磨牙、乳尖牙及第二乳磨牙，即A→B→D→C→E（B对）。